痢疾杆菌在外界环境的生存力以哪个群的生存力最强
A. 福氏菌
B. 志贺菌
C. 宋内菌
D. 沙门菌
E. 生存力均一样

正确答案：C。宋内菌